甲型肝炎病毒属于
A. 正黏病毒科
B. 副黏病毒科
C. 小RNA病毒科
D. 呼肠病毒科
E. 冠状病毒科

正确答案：C。小RNA病毒科

解析：甲型肝炎病毒属于小RNA病毒科（C对），小RNA病毒科还包括鼻病毒、肠道病毒等。正粘病毒科（A错）只有流行性感冒病毒（流感）一个种，包括人流感病毒和动物流感病毒（P238）。副黏病毒科（B错）包括麻疹病毒、副流感病毒、呼吸道合胞病毒、腮腺炎病毒等（P242）。呼肠病毒科（D错）包括轮状病毒等（P257）。冠状病毒科（E错）包括SARS冠状病毒、人其他型别冠状病毒等（P246）。